龟鹿补肾丸具有补肾壮阳、益气血、壮筋骨的功能。处方组成：盐菟丝子51g、淫羊藿（蒸）43g、续断（盐蒸）43g、锁阳（蒸）51g、狗脊（盐蒸）64g、酸枣仁（炒）43g、制何首乌64g、炙甘草21g、陈皮（蒸）21g、鹿角胶（炒）9g、熟地黄64g、龟甲胶（炒）13g、金樱子（蒸）51g、炙黄芪43g、山药（炒）43g、覆盆子（蒸）85g。以上十六味，粉碎成细粉，过筛，混匀，每100g粉末加炼蜜40g，加适量水泛丸，干燥，制成水蜜丸；或加炼蜜100～110g制成大蜜丸，即得。关于处方中制何首乌化学成分和炮制作用的说法，错误的是
A. 何首乌炮制后增加补肝肾、益精血的作用
B. 何首乌炮制后味转甘厚，性转温
C. 何首乌炮制后二苯乙烯苷含量降低
D. 何首乌炮制后结合蒽醌类成分含量增加
E. 何首乌炮制后消除生品滑肠致泻的副作用

正确答案：D。何首乌炮制后结合蒽醌类成分含量增加

解析：本题考查何首乌炮制作用。关于处方中制何首乌化学成分和炮制作用的说法，错误的是何首乌炮制后结合葱醌类成分含量增加（D错，为本题正确答案）。何首乌【炮制作用】何首乌味苦、甘、涩，性温。归肝、心、肾经。①生何首乌苦泄性平兼发散，具有解毒消肿、润肠通便、截疟的功能。用于瘰疬疮痈，风疹瘙痒，肠燥便秘，久疟不止，高脂血症。②制何首乌味转甘厚而性转温（B对），增强了补肝肾、益精血（A对）、乌须发、强筋骨的作用，用于血虚萎黄，眩晕耳鸣，须发早白，腰膝酸软，肢体麻木，崩漏带下，久疟体虚，高脂血症。同时消除了生何首乌滑肠致泻的副作用（E对），使慢性病患者长期服用而不造成腹泻。首乌蒸制过程中，外表颜色加深，总蒽醌、结合蒽醌含量随着蒸制时间延长而减少，游离蒽醌开始增加，使致泻作用减弱。制首乌的磷脂类成分和糖的含量增加，使补益作用更加突出。二苯乙烯苷含量随蒸制时间增加而降低（C对）。